侧腭杆离开龈缘的距离至少是
A. 1～2mm
B. 2～4mm
C. 4～6mm
D. 6～8mm
E. 8～10mm

正确答案：C。4～6mm

解析：本题考查局部义齿连接体。侧腭杆：位于上颌硬区的两侧，离开龈缘应有4～6mm（C对），并且与牙弓平行，用于连接前、后腭杆，一侧或两侧（双杆）均可。其强度好，不易变形，戴用舒适。